某男，25岁。因上呼吸道感染，临床给予喜炎平注射液150mg，加入到5%葡萄糖注射液250ml中静脉滴注，输液5分钟后，患者出现寒战、发热、心悸、前胸及后背皮肤多发红疹，伴瘙痒，渐至呼吸困难，随即停止输液，予以对症处理，药师分析为喜炎平引起的药物不良反应。该不良反应的类型是
A. 过敏反应
B. 副作用
C. 毒性反应
D. 继发反应
E. 后遗作用

正确答案：A。过敏反应

解析：本题考查的是中药药物不良反应的病因学分类。因上呼吸道感染，临床给予喜炎平注射液150mg，加入到5%葡萄糖注射液250ml中静脉滴注，输液5分钟后，患者出现寒战、发热、心悸、前胸及后背皮肤多发红疹，伴瘙痒，渐至呼吸困难，随即停止输液，予以对症处理，药师分析为喜炎平引起的药物不良反应。该不良反应的类型是过敏反应（A对）。中药药物不良反应的病因学分类：（1）与药物剂量有关的中药不良反应：该类型由药物本身或其代谢物所引起，使固有药理作用持续和增强。由于不同个体在药物吸收、分布、代谢及排泄等方面的差异，导致单位时间内药物浓度异常升高，引起有关组织器官的不良反应。其不良反应包括药物的副作用（B错）、毒性作用（C错），以及继发反应（D错）、首剂效应、后遗作用（E错）等。该类型具有剂量依赖性和可预测性，个体易感性差异大，并受年龄、性别、病理状态等因素影响，一旦发生，后果十分严重，甚至可导致死亡。（2）与药物剂量无关的中药不良反应：该类型与药物固有的正常药理作用无关，而与药物变性（如药物有效成分降解产生有害物质）和人体特异体质（指患者的特殊遗传素质）有关。该类型与用药剂量无关，难以预测，经常规的毒理学筛选也很难发现，发生率虽较低，但危险性大，病死率较高。此类伤害又可分为两种。①特异质反应：指由于遗传因素机体产生的不良反应。为患者先天性代谢紊乱表现的特殊形式，即只有在接触某种药物后才表现出来的先天性代谢异常。②变态反应：亦称药物过敏反应。本质上是一类病理性免疫反应，由抗原抗体的相互作用引起，与药物的药理作用无关。过敏反应对机体的危害程度轻重不一，轻者停药后可恢复，重者甚可致死亡。从接触抗原至出现症状，时间差异很大，反应持续时间也不相同。